乳牙患龋高峰年龄段为
A. 2～3岁
B. 3～4岁
C. 5～8岁
D. 7～8岁
E. 9～10岁

正确答案：C。5～8岁

解析：本题考查乳牙患龋高峰的年龄段。乳牙萌出后不久即可患龋，在5～8岁（C对）是乳牙患龋高峰年龄段，此时乳牙已完全萌出，儿童难以自觉维护口腔卫生，又喜甜食，达到患龋高峰。6岁左右，恒牙开使萌出，儿童的维护口腔卫生的意识也有所提高，患龋率逐渐下降。